随着年龄的增长，牙齿（牙合）面和邻面由于咀嚼作用而发生的均衡的磨损称为
A. 磨损
B. 龋病
C. 磨耗
D. 酸蚀
E. 楔缺

正确答案：C。磨耗

解析：在正常生理咀嚼过程中，随着年龄的增长，牙齿（牙合）面和邻面由于咀嚼作用而发生的均衡的磨损称为生理性磨耗。掌握“磨损”知识点。